疣状癌的好发部位是
A. 下唇黏膜
B. 颊黏膜
C. 舌背黏膜
D. 牙龈黏膜
E. 牙槽黏膜

正确答案：A。下唇黏膜

解析：本题考查疣状癌。疣状癌的好发部位是下唇黏膜（A对）。疣状癌为一种非转移性的高分化鳞癌的亚型，以外生性、疣状缓慢生长和边缘推压为特征。烟草可能是口腔疣状癌的主要病因学因素。疣状癌以老年男性下唇多见，颊（B错）、舌背（C错）、牙龈（D错）、牙槽黏膜（E对）均可发生。病变开始时为边界清楚、细的白色角化斑块，迅速变厚，发展成钝的乳头状或疣状，表面突起。